齐墩果酸属于
A. 单萜
B. 倍半萜
C. 二萜
D. 三萜
E. 四萜

正确答案：D。三萜

解析：本题考查的是皂苷的分类。齐墩果酸属于三萜（D对）。萜类化合物是一类由甲戊二羟酸衍生而成，基本碳架多具有2个或2个以上异戊二烯单位（C5单位）结构特征的不同饱和程度的衍生物。按照分子中异戊二烯单位的数目可将萜类化合物分为单萜、倍半萜、二萜、二倍半萜、三萜、四萜及多萜。1.单萜（A错）：单萜是指基本碳架由2分子异戊二烯单位构成，含有10个碳原子的萜烯及其衍生物。单萜类化合物是挥发油的主要组成成分之一（单萜苷类不具随水蒸气蒸馏的性质），常存在于菊科、唇形科、樟科、桃金娘科、芸香科、伞形科、姜科、松科等植物的腺体、油室及树脂道等分泌组织内。昆虫和微生物的代谢产物以及海洋生物中也含有单萜。单萜类化合物有玫瑰油、香叶天竺葵油、柠檬草油和香茅油等中的香叶醇（牻牛儿醇）；薄荷中的薄荷醇；冰片中的龙脑等。2.环烯醚萜类：环烯醚萜类为臭蚁二醛的缩醛衍生物，属单萜类化合物。环烯醚萜类化合物在中药中分布较广，特别是在玄参科、茜草科、唇形科及龙胆科中较为常见。环烯醚萜类化合物具有广泛的生物活性，如具有保肝、利胆、降血糖、降血脂、抗炎等作用。环烯醚萜类化合物有栀子中的栀子苷、京尼平苷、京尼平苷酸；鸡屎藤中的鸡屎藤苷；地黄中的梓醇、梓苷；龙胆中的龙胆苦苷；獐牙菜中的獐牙菜苷及獐牙菜苦苷等。3.倍半萜（B错）：倍半萜类是由3个异戊二烯单位构成的天然萜类化合物。倍半萜及其含氧化合物多与单萜类共存于植物挥发油中，是挥发油高沸程（250℃～280℃）的主要组分，也有低沸点的固体。在植物界中多以醇、酮、内酯或苷的形式存在。如香茅草、橙花、玫瑰等中金合欢醇（法尼醇）；青蒿（黄花蒿）中的青蒿素；马桑毒素；羟基马桑毒素；莪术中的莪术醇等。4.二萜（C错）：是指骨架由4个异戊二烯单位构成，含20个碳原子的一类萜类衍生物。绝大多数不能随水蒸气蒸馏。二萜多以树脂、内酯或苷等形式广泛存在于自然界。不少二萜含氧衍生物具有很好的生物活性，如穿心莲内酯、芫花酯、雷公藤内酯、银杏内酯、紫杉醇等。5.三萜：基本骨架由6个异戊二烯单位组成。三萜的种类很多，但以皂苷形式存在的三萜类型并不多，较为常见的有羊毛甾烷型、达玛烷型、齐墩果烷型、乌苏烷型和羽扇豆烷型，其中前两种属于四环三萜，后三种则属于五环三萜。（1）四环三萜：结构与甾醇很类似。主要有以下类型。①羊毛甾烷型，如猪苓酸A。②达玛烷型，如20（S）-原人参二醇。（2）五环三萜：主要有以下类型。①齐墩果烷型：此类以齐墩果酸最为多见。②乌苏烷型，此类大多是乌苏酸的衍生物。③羽扇豆烷型，如羽扇豆种子中存在的羽扇豆醇，酸枣仁中分得的白桦醇和白桦酸等。6.四萜（E错）：基本骨架由6个异戊二烯单位组成，大多以植物胡萝卜素形式存在。